由国务院药品监督管理部门会同国务院卫生行政部门制定的是
A. 新药临床试验审批办法
B. 药品不良反应报告具体办法
C. 药物临床试验机构资格认定办法
D. 中药品种保护管理办法
E. 药物临床试验质量管理规定

正确答案：B。药品不良反应报告具体办法

解析：本题考查药品不良反应。由国务院药品监督管理部门会同国务院卫生行政部门制定的是药品不良反应报告具体办法（B对）。国家实行药品不良反应报告制度。药品生产企业、药品经营企业和医疗机构必须经常考察本单位所生产、经营、使用的药品质量、疗效和反应。发现可能与用药有关的严重不良反应，必须及时向当地省、自治区、直辖市人民政府药品监督管理部门和卫生行政部门报告。具体办法由国务院药品监督管理部门会同国务院卫生行政部门制定。对已确认发生严重不良反应的药品，国务院或者省、自治区、直辖市人民政府的药品监督管理部门可以采取停止生产、销售、使用的紧急控制措施，并应当在五日内组织鉴定，自鉴定结论作出之日起十五日内依法作出行政处理决定。新药临床试验的审批（A错）需经国务院药品监督管理部门制定。药物临床试验机构资格的认定办法（C错），由国务院药品监督管理部门、国务院卫生行政部门共同制定。中药品种保护管理办法（D错）由国务院制定。药物临床试验质量管理规范（E错）由国务院确定的部门制定。